关于牙槽骨吸收的程度描述错误的是
A. 牙槽骨吸收的程度一般按吸收区与牙根长度的比例来描述
B. Ⅰ度牙槽骨吸收在牙根的颈1/3以内
C. Ⅱ度牙槽骨吸收超过根长1/3，但在根长2/3以内
D. Ⅲ度牙槽骨吸收占根长2/3以上
E. Ⅳ度牙槽骨吸收占根长3/4以上

正确答案：E。Ⅳ度牙槽骨吸收占根长3/4以上

解析：骨吸收的程度一般按吸收区占牙根长度的比例来描述，通常分为三度。Ⅰ度：牙槽骨吸收在牙根的颈1/3以内；Ⅱ度：牙槽骨吸收超过根长1/3，但在根长2/3以内，或吸收达根长的1/2；Ⅲ度：牙槽骨吸收占根长2/3以上。E项为干扰项，本身表达错误，是错误选项。掌握“牙周疾病检查”知识点。